CD4阳性T细胞的主要功能是
A. 特异性杀伤作用
B. 吞噬作用
C. 辅助作用
D. 抑制作用
E. 抗原呈递作用

正确答案：C。辅助作用

解析：CD4是跨膜糖蛋白，表达在辅助性T细胞（Th）表面。CD4可特异结合MHCⅡ类分子，是ThTCR的辅助受体。树突细胞、单核细胞和巨噬细胞也表达CD4。表达CD4的T细胞是Th，识别抗原时受MHCⅡ类分子限制。掌握“B淋巴细胞”知识点。